治疗敏感的G+球菌所致感染首选药为
A. 第一代头孢菌
B. 第二代头孢菌
C. 第三代头孢菌
D. 青霉素类
E. 红霉素

正确答案：D。青霉素类

解析：青霉素类肌内注射或静脉滴注为治疗敏感的G+球菌和杆菌、G-球菌及螺旋体所致感染的首选药。掌握“青霉素及头孢菌素类药”知识点。